下列方剂中，组成药物中不含有栀子的是
A. 茵陈蒿汤
B. 八正散
C. 凉膈散
D. 龙胆泻肝汤
E. 仙方活命饮

正确答案：E。仙方活命饮

解析：仙方活命饮（E错，为本题正确答案）组成为白芷、贝母、防风、赤芍、皂角刺、当归、甘草、穿山甲、天花粉、乳香、没药、金银花、陈皮（仙方活命金银花，玄参当归甘草加，清热解毒兼活血，热毒脱疽效堪夸）；茵陈蒿汤（A对）组成为茵陈、栀子、大黄；八正散（B对）组成为车前子、瞿麦、萹蓄、滑石、山栀子、甘草、木通、大黄；凉膈散（C对）组成为大黄、朴硝、甘草、山栀子、薄荷、黄芩、连翘、竹叶、蜜；龙胆泻肝汤（D对）组成为龙胆草、黄芩、栀子、泽泻、木通、当归、生地、柴胡、生甘草、车前子。